《素问·阴阳应象大论》论疾病治疗方法，认为“气剽悍者”可以
A. 汗而发之
B. 涌而越之
C. 引而竭之
D. 按而收之
E. 因而越之

正确答案：D。按而收之

解析：“其慓悍者，按而收之”这句话的意思是对于邪气急猛的病证，采用适当措施，以遏其势，以缓其急，待病势收敛，病情缓解后，再审因论治（D对）。“其在皮者，汗而发之（A错）。其高者，因而越之（E错）。其下者，引而竭之（C错）”。